下列变化中属于物理配伍变化的有
A. 在含较多黏液质和蛋白质的水溶液中加入大量的醇后产生沉淀
B. 散剂、颗粒剂在吸湿后又逐渐干燥而结块
C. 混悬剂因久贮而发生颗粒粒径变大
D. 维生素C与烟酰胺混合后产生橙红色固体
E. 溴化铵与强碱性药物配伍时产生氨气

正确答案：A、B、C。在含较多黏液质和蛋白质的水溶液中加入大量的醇后产生沉淀；散剂、颗粒剂在吸湿后又逐渐干燥而结块；混悬剂因久贮而发生颗粒粒径变大

解析：本题考查药物的配伍变化。在含较多黏液质和蛋白质的水溶液中加入大量的醇后产生沉淀（A对）、散剂、颗粒剂在吸湿后又逐渐干燥而结块（B对）、混悬剂因久贮而发生颗粒粒径变大（C对）均为物理配伍变化；维生素C与烟酰胺混合后产生橙红色固体（D错）、溴化铵与强碱性药物配伍时产生氨气（E错）均为化学配伍变化。